患者首次使用西妥昔单抗，为减轻其不良反应，常规预处理使用的药物是
A. 抗组胺类药物
B. 化疗止吐类药物
C. 质子泵抑制剂
D. 维生素类药物
E. 抗胆碱类药物

正确答案：A。抗组胺类药物

解析：本题考查西妥昔单抗。患者首次使用西妥昔单抗，为减轻其不良反应，常规预处理使用的药物是抗组胺类药物（A对）。应用西妥昔单抗治疗可能发生皮肤过敏反应，可合用抗组胺药减轻其不良反应。